根据我国法律，不允许青少年捐献器官，最主要的原因是
A. 青少年认知不足
B. 主治医师的情感
C. 器官摘除医师的心理负担
D. 器官年轻，用处不大
E. 社会大众的普遍反对

正确答案：A。青少年认知不足

解析：青少年认知能力不足，未拥有成熟的三观，因此不允许进行器官捐献（A对）。